温热性对人体的不良作用是
A. 腻膈
B. 助湿
C. 伤阴
D. 败胃
E. 敛邪

正确答案：C。伤阴

解析：本题考查的是药物四气的所示效用。温热性对人体的不良作用是伤阴（C对）。四气，从本质而言只有寒热二性。凡寒凉性药物，即表示其具有清热、泻火、凉血、解热毒等作用；凡温热性药物，即表示其具有温里散寒、补火助阳、温经通络、回阳救逆等作用。四气对人体的作用也有两面性，倘若应用不当，即可对人体产生不良作用。此时，寒凉性有伤阳助寒之弊，而温热性则有伤阴助火之害。腻膈（A错）是甘味药的不良效果。甘味药大多能腻膈碍胃，令人中满，凡湿阻、食积、中满气滞者慎用。敛邪（E错）为酸味药的作用。酸味药大多能收敛邪气，凡邪未尽之证均当慎用。